遗传性血管神经性水肿
A. HIV感染
B. C1-INH缺乏
C. 先天性胸腺发育不全
D. Bruton酪氨酸激酶基因缺陷
E. 还原型辅酶Ⅱ氧化酶系统基因缺陷

正确答案：B。C1-INH缺乏

解析：C3缺陷患者易发生严重的致死性化脓菌感染。C1抑制物（C1-INH）的缺陷患者易发生遗传性血管神经性水肿。掌握“免疫缺陷概述及原发性、获得性免疫缺陷病”知识点。